泪滴形红细胞常见于以下哪种疾病
A. 巨幼细胞性贫血
B. 真性红细胞增多症
C. 缺铁性贫血
D. 骨髓纤维化
E. 以上都有

正确答案：D。骨髓纤维化

解析：泪滴形红细胞：细胞呈泪滴状或手镜状，见于骨髓纤维化（D对）、珠蛋白生成障碍性贫血、溶血性贫血等。巨幼细胞性贫血（A错）可见红细胞大小不均；真性红细胞增多症（B错）是一种原因未明的以红细胞增多为主的骨髓增生性疾病，早期红细胞大多正常或轻度大小不均，随疾病发展出现脾大伴活跃髓外造血时，可出现有核红细胞、红细胞大小、形态不等，可见椭圆、泪滴样红细胞和嗜碱点彩样红细胞；缺铁性贫血（C错）可见少量靶形红细胞。